关于脊髓运动神经元的描述，正确的是
A. 是前角中的小型神经元
B. 发出纤维支配梭外肌
C. 与肌张力的调节有关
D. 参加脊髓节段内和节段间反射
E. 以上都是

正确答案：E。以上都是

解析：脊髓运动神经元包括大型的a-运动神经元和小型的γ-运动神经元，参与脊髓节段内和节段间反射，a-运动神经元的纤维支配跨关节的梭外肌纤维，引起关节运动。γ－运动神经元支配梭内肌纤维，其作用与肌张力调节有关（E对）。